（Ⅰ）比（Ⅱ）局麻活性强的原因是
A. 亚氨基使（Ⅰ）碱性强，易与受体通过离子键结合
B. （Ⅰ）的水溶性比（Ⅱ）大，不易透过血管壁
C. （Ⅰ）的羟基极性增大，易与受体通过偶极作用结合
D. （Ⅱ）的脂溶性大，易透过皮肤
E. （Ⅰ）不易被水解

正确答案：C。（Ⅰ）的羟基极性增大，易与受体通过偶极作用结合